酸枣仁的功效是
A. 润肠通便
B. 利水消肿
C. 养心安神
D. 止咳平喘
E. 补肾助阳

正确答案：C。养心安神

解析：本题考查酸枣仁的功效。酸枣仁的功效是养心安神（C对）。酸枣仁【功效】养心安神，敛汗。火麻仁【功效】润肠通便（A错）。郁李仁【功效】润肠通便，利水消肿（B错）。马兜铃【功效】清肺化痰，止咳平喘（D错），清肠疗痔。海马【功效】补肾助阳（E错），活血散结，消肿止痛。